女，20岁。1个月前因工作差错被领导批评后出现心情烦躁，经常哭泣，认为自己没有能力，什么事都干不好，周围人的眼神不怀好意，看她笑话。失眠，早醒。近一周病情加重，觉得生不如死，在家中拒食等死。该患者不宜使用的药物是
A. 喹硫平
B. 文拉法辛
C. 卡马西平
D. 碳酸锂
E. 丙戊酸钠

正确答案：A。喹硫平

解析：该患者1个月前出现心情烦躁、经常哭泣（心境低落），认为自己没有能力、什么事都干不好（自我评价降低），失眠、早醒（睡眠障碍），近一周病情加重，拒食等死（自杀行为），故最可能的诊断为抑郁发作，喹硫平为第二代抗精神病药物，主要用于精神分裂症（A错，为本题正确答案）。文法拉辛为抗抑郁药，主要用于抑郁发作（B对）。卡马西平、碳酸锂、丙戊酸钠均为心境稳定剂，可用于抑郁发作（CDE对）。